家用洗涤剂的表面活性剂主要是
A. 烷基硫酸盐
B. 溴化烯基二甲基乙基铵
C. 烷基苯磺酸钠
D. 聚氧乙烯壬基苯基醚
E. 氯化烷基二甲基苄铵

正确答案：C。烷基苯磺酸钠

解析：本题考查家用洗涤剂的表面活性剂。目前最普遍的家用洗涤剂是阴离子型合成洗涤剂，表面活性剂为烷基苯磺酸钠（ABS）（C对ABDE错）。ABS分为硬型（有支链）和软型（无支链或仅一个支链），相对而言，前者对水体污染或对人类和水中动植物的危害比较大。